HIV与感染细胞膜上CD4分子结合的病毒刺突是
A. gp120
B. gp41
C. p24
D. pl7
E. gp160

正确答案：A。gp120

解析：HIV主要侵犯宿主的CD4+T淋巴细胞，HIV与感染细胞膜上CD4分子结合的病毒刺突是gp120（A对），gp120使病毒吸附于细胞表面，引起靶细胞的一系列改变，使病毒核心进入靶细胞。